医疗保健机构提供的孕产期保健服务的内容包括
A. 孕产妇保健、胎儿保健
B. 孕产妇保健、新生儿保健
C. 胎儿保健、新生儿保健
D. 孕产妇保健、胎儿保健、新生儿保健
E. 孕产妇保健、胎儿保健、新生儿保健、母婴保健指导

正确答案：E。孕产妇保健、胎儿保健、新生儿保健、母婴保健指导

解析：本题考查医疗保健机构提供的孕产期保健服务的内容。医疗保健机构提供的孕产期保健服务的内容。包括：孕产妇保健、胎儿保健、新生儿保健、母婴保健指导（E对ABCD错）。